有抗血小板聚集和抗血栓形成作用
A. 氯丙嗪
B. 阿司匹林
C. 两者均有
D. 两者均无

正确答案：B。阿司匹林

解析：本题考查阿司匹林。阿司匹林（B对）为环氧化酶的不可逆抑制剂，通过阻断前列腺素的生物合成起到解热、镇痛、抗炎的作用；也可减少血小板血栓素A₂的生成，起到抑制血小板聚集和防止血栓形成的作用。氯丙嗪为吩噻嗪类抗精神病药，主要用于治疗精神分裂症和躁狂症，亦可治疗神经官能症的焦虑和紧张状态，大剂量时，还可用于镇吐、低温麻醉和人工冬眠等。